对生产环境气象条件的正确描述是
A. 生产环境的气象条件包括气温、气压、气湿、热辐射
B. 生产环境的气象条件包括气温、气流、气湿、热辐射
C. 热辐射主要来源于可见光
D. 相对湿度大于90％为高气湿，小于30％为低气湿
E. 相对湿度大于80％为高气湿，小于20％为低气湿

正确答案：B。生产环境的气象条件包括气温、气流、气湿、热辐射